易通过血脑屏障的药物是
A. 异烟肼
B. 链霉素
C. 阿米卡星
D. 司帕沙星
E. 庆大霉素

正确答案：A。异烟肼

解析：能够透过血脑屏障的抗生素有哌拉西林、阿莫西林、头孢曲松、甲硝唑以及异烟肼、吡嗪酰胺、利福平，抗病毒的药有阿昔洛韦、利巴韦林（A对）。